生物转化可使毒物转变为
A. 毒性降低
B. 毒性增加
C. 活性降低
D. 活性增加
E. 有的毒物毒性降低，有的毒性则增加

正确答案：E。有的毒物毒性降低，有的毒性则增加